对母体及胎儿有一定的耳、肾毒性，仅在有明确指征时方可使用，并应进行治疗药物监测的治疗耐药革兰阳性菌所致严重感染的药品是
A. 左氧氟沙星
B. 氯霉素
C. 磷霉素
D. 万古霉素
E. 甲硝唑

正确答案：D。万古霉素

解析：本题考查妊娠期用药。对母体及胎儿有一定的耳、肾毒性，仅在有明确指征时方可使用，并应进行治疗药物监测的治疗耐药革兰阳性菌所致严重感染的药品是万古霉素（D对）。万古霉素为糖肽类抗菌药物，对革兰阳性菌有强大的抗菌活性。可导致听力减退，甚至耳聋。妊娠期妇女应避免使用。哺乳期妇女试用期间应暂停哺乳。仅在有明确指征时方可使用，在应用万古霉素治疗过程中应监测血浆药物浓度，尤其是需延长疗程者或有肾功能、听力减退者和耳聋病史者。左氧氟沙星（A错）属于喹诺酮类药物，喹诺酮类对乳儿骨关节有潜在危害，不宜应用。氯霉素（B错）在乳汁中的浓度为血清中的一半，有明显骨髓抑制作用，可引起灰婴综合征，故哺乳期禁用。磷霉素（C错）存在于母乳中，哺乳期妇女慎用，用药时暂停哺乳。甲硝唑（E错）禁用于妊娠期妇女及哺乳期妇女。